治疗肾虚型牙痛，除取主穴外，应加用的腧穴是
A. 外关、风池
B. 太溪、行间
C. 太溪、外关
D. 太冲、曲池
E. 太冲、阳溪

正确答案：B。太溪、行间

解析：针灸治疗牙痛总治法为祛风泻火、通络止痛，选穴以手足阳明经为主。主穴选颊车、下关、合谷；风火牙痛加外关、风池（A错）。阴虚牙痛加太溪、行间。肾主骨，齿为骨之余，肾阴不足，虚火上炎可以起牙痛，故肾虚牙痛应选择肾经原穴太溪补肾配合行间泻火止痛（B对）。外关主要用于治疗热病、头痛、目赤肿痛、耳鸣、耳聋等头面五官病证（C错）。曲池主要用于治疗上肢不遂等上肢病证、热病、腹痛吐泻等肠胃病证（D错）。阳溪主治手腕痛、头痛、耳聋等（E错）。